患儿，10个月。发热、咳嗽半天，突然痉厥昏迷，舌红，苔薄黄，指纹浮紫，其治法是
A. 疏风清热，息风定惊
B. 平肝息风，清心开窍
C. 清气凉营，息风开窍
D. 清热化湿，解毒息风
E. 镇惊安神，平肝息风

正确答案：A。疏风清热，息风定惊

解析：患儿于外感表证过程中突然出现痉厥昏迷，故诊断为急惊风。风热之邪侵于肺卫，邪正交争于肌表，则见发热；风邪袭肺则见咳嗽；风邪郁而化热，热扰心肝二经，则见突然痉厥昏迷；舌红，苔薄黄，指纹浮紫，为风热在表之象，故其证型为风热动风证，治以疏风清热，息风定惊，方药为银翘散（A对）。平肝息风，清心开窍（B错）适用于急惊风之邪陷心肝证。清气凉营，息风开窍（C错）适用于急惊风之气营两燔证。清热化湿，解毒息风（D错）适用于急惊风之湿热疫毒证。镇惊安神，平肝息风（E错）适用于急惊风之暴受惊恐证。